排龈刀属于
A. 高危器械
B. 中危器械
C. 低危器械
D. 中水平消毒器械
E. 高水平消毒器械

正确答案：A。高危器械

解析：本题考查口腔器械的分类。排龈刀属于高危器械（A对）。排龈刀属于高危器械，为灭菌水平；中度危险器械为灭菌或高水平消毒；低度危险器械为中低度水平消毒。口腔器械按照在使用时可能造成的危险程度分为高度危险器械、中度危险器械、低度危险器械三个级别。①高危器械指接触患者口腔伤口、血液、破损黏膜或进入口腔无菌组织、或穿破口腔软组织进入骨组织或牙齿内部的各类口腔器械；②中危器械指仅接触完整的黏膜或破损的皮肤，而不进入无菌组织器官的口腔器械；③低危器械指不接触患者口腔或间接接触患者口腔，参与口腔诊疗服务，虽有微生物污染，但在一般情况下无害，只有受到一定量的病原微生物污染时才造成危害的口腔器械。